流行性出血热的传染源主要是
A. 患者
B. 家畜
C. 毛蚶
D. 鼠类
E. 蚊虫

正确答案：D。鼠类

解析：鼠类为流行性出血热的主要传染源（D对）。其他还有猫、狗、猪和免等，我国以黑线姬鼠和褐家鼠为主，林区以大林姬鼠为主。虽然早期患者的血液和尿液中携带病毒，但人不是主要传染源。有些传染病，如麻疹、天花、水痘等，患者是唯一的传染源（A错）。流行性乙型脑炎主要传染源是家畜，尤其是未经流行季节的幼猪（B错）。